中年男性患者，近两周来出现头晕乏力，鼻腔出血等症，查体：颈部浅表淋巴结肿大，下肢少许瘀斑。白细胞16.6×109/L，原始细胞0.60，血红蛋白80g/L，血小板34×109/L。为明确诊断应做的检查是
A. 血小板抗体
B. 血清铁蛋白
C. 骨髓扫描
D. 淋巴结活检
E. 骨髓涂片细胞学检查

正确答案：E。骨髓涂片细胞学检查

解析：骨髓象检查可提供确诊依据。掌握“急性白血病”知识点。